急性菌痢基本病变主要部位是
A. 乙状结肠直肠
B. 升结肠
C. 横结肠
D. 小肠回盲部
E. 空肠

正确答案：A。乙状结肠直肠